构成牙的大部分呈淡黄色
A. 牙冠
B. 牙骨质
C. 牙质
D. 牙龈
E. 牙周膜

正确答案：C。牙质

解析：牙质(C对)构成牙的大部分，呈淡黄色。